不是肉毒梭菌特点的是
A. 芽胞位于菌体次极端，菌体呈网球拍状
B. 专性厌氧
C. 致病物质主要是肉毒毒素
D. 引起疾病主要是细菌性食物中毒
E. 肉毒毒素作用机制是阻止神经组织释放乙酰胆碱

正确答案：D。引起疾病主要是细菌性食物中毒

解析：肉毒梭菌所致疾病：毒素经肠道吸收，进入血液，作用于颅脑神经核、外周神经-肌肉接头处，阻碍乙酰胆碱的释放，导致肌肉弛缓型麻痹即肉毒中毒。掌握“厌氧芽胞梭菌”知识点。